以色紫红、质坚实、富油性，香气浓者为佳的药材是
A. 降香
B. 沉香
C. 苏木
D. 钩藤
E. 通草

正确答案：A。降香

解析：本题考查的是降香药材的性状鉴别。以色紫红、质坚实、富油性，香气浓者为佳的药材是降香（A对）。降香：【性状鉴别】药材呈类圆柱形或不规则块状。表面紫红色或红褐色，切面有致密的纹理。质硬，有油性。气微香，味微苦。以色紫红、质坚实、富油性，香气浓者为佳。沉香（B错）：【性状鉴别】药材呈不规则块状、片状或盔帽状，有的为小碎块。表面凹凸不平，有刀削痕，偶有孔洞，可见黑褐色树脂与黄白色木部相间的斑纹、孔洞及凹窝。表面多呈朽木状。质较坚实，断面刺状。气芳香，味苦。燃烧时有浓烟及强烈香气，并有黑色油状物渗出。以色黑、质坚硬、油性足、香气浓而持久、能沉水者为佳。苏木（C错）：【性状鉴别】药材呈长圆柱形或对剖半圆柱形。表面黄红色至棕红色，具刀削痕，常见纵向裂缝。质坚硬，断面略具光泽，年轮明显，有的可见暗棕色、质松、带亮星的髓部。气微，味微涩。钩藤（D错）：【性状鉴别】药材为带单钩或双钩的茎枝小段。茎枝呈圆柱形或类方柱形。表面红棕色至紫红色者，具细纵纹，光滑无毛；黄绿色至灰褐色者有的可见白色点状皮孔，被黄褐色柔毛。多数枝节上对生两个向下弯曲的钩（不育花序梗），或仅一侧有钩，另一侧为突起的疤痕；钩略扁或稍圆，先端细尖，基部较阔；钩基部的枝上可见叶柄脱落后的窝点状痕迹和环状托叶痕。质坚韧，断面黄棕色，皮部纤维性，髓部黄白色或中空。气微，味淡。以双钩、茎细、钩结实、光滑、色紫红，无枯枝者为佳。通草（E错）：【性状鉴别】药材呈圆柱形。表面白色或淡黄色，有浅纵沟纹。体轻，质松软，稍有弹性，易折断。断面平坦，显银白色光泽，中部有直径0.3～1.5cm的空心或半透明圆形的薄膜，纵剖面薄膜呈梯状排列，实心者少见。气微，味淡。以条粗、色洁白、有弹性者为佳。